一青年妇女在初次使用护肤霜后未出现任何反应，连续使用多日后，皮肤逐渐出现红斑，并有皮肤干燥、皲裂，以后发展为丘疹、疱疹样湿疹等皮肤炎症，皮肤发痒，有不适和疼痛感。这种情况可能是
A. 刺激性接触性皮炎
B. 变应性接触性皮炎
C. 光变应性皮炎
D. 化妆品性痤疮
E. 真菌性皮肤损害

正确答案：A。刺激性接触性皮炎